第1鳃沟发育异常导致的先天性耳前瘘管的具体位置为
A. 腮腺导管口
B. 耳垂下方
C. 耳屏前方
D. 下颌角
E. 腮腺深叶

正确答案：C。耳屏前方

解析：第一鳃沟或者第一第二鳃弓发育异常时，可在耳屏前方形成皮肤的狭窄盲管或点状凹陷。多为先天性耳前窦道。若此盲管继续向深部生长，与鼓室相通，即为耳前瘘管。掌握“鳃弓与神经嵴”知识点。